能引起子宫内膜增生过长的卵巢肿瘤是
A. 成熟囊性畸胎瘤
B. 卵泡膜细胞瘤
C. 内膜样肿瘤
D. 内胚窦瘤
E. 浆液性囊腺瘤

正确答案：B。卵泡膜细胞瘤

解析：能引起子宫内膜增生过长的卵巢肿瘤是卵泡膜细胞瘤（B对），其属于卵巢性索间质肿瘤，具有内分泌功能，能分泌雌激素，使子宫内膜增生过长，常与颗粒细胞瘤同时存在，但也可为单一成分。成熟囊性畸胎瘤（P329）（A错）和内胚窦瘤（P329）（D错）属于卵巢生殖细胞瘤、内膜样肿瘤（P327）（C错）和浆液性囊腺瘤（P326）（E错）属于卵巢上皮性肿瘤，均无内分泌功能，不能引起子宫内膜增生。